急腹症的中期，常表现为
A. 正盛邪轻
B. 正盛邪实
C. 正虚邪陷
D. 邪却正复
E. 正虚邪恋

正确答案：B。正盛邪实

解析：急腹症分为初、中、后三期，反应了正邪斗争的消长过程。初起正盛邪轻（A错），中期正盛邪实（B对），后期正虚邪陷（C错），邪却正复（D错），正虚邪恋（E错）。